急性肾衰竭多尿期出现多尿的机制是
A. 肾小管阻塞
B. 肾小管上皮细胞肿胀
C. 肾血流量减少
D. 肾间质水肿
E. 肾小管上皮细胞重吸收钠、水功能尚未恢复

正确答案：E。肾小管上皮细胞重吸收钠、水功能尚未恢复

解析：多尿期产生多尿的机制是：①肾血流量和肾小球滤过功能逐步恢复正常（C错）；②肾小管上皮细胞开始再生修复（B错），但是新生的肾小管上皮细胞功能尚不成熟（E对），钠水重吸收功能仍低下；③肾间质水肿消退（D错），肾小管内管型被冲走，阻塞解除（A错）；④少尿期中潴留在血中的尿素等代谢产物经肾小球大量滤出，产生渗透性利尿